有关水丸起模的叙述，正确的有
A. 水丸起模宜选用黏性适中的药粉
B. 水丸起模常以水作为润湿剂
C. 水丸起模有粉末直接起模、湿制颗粒起模和包衣造粒机起模等方法
D. 水丸起模用粉量应根据药粉的性质和丸粒的规格决定
E. 传统法起模丸模成型率高且较均匀，改进法起模制得的丸模较紧密且圆整

正确答案：A、B、C、D。水丸起模宜选用黏性适中的药粉；水丸起模常以水作为润湿剂；水丸起模有粉末直接起模、湿制颗粒起模和包衣造粒机起模等方法；水丸起模用粉量应根据药粉的性质和丸粒的规格决定

解析：本题考查水丸的制备。有关水丸起模的叙述，正确的有水丸起模宜选用黏性适中的药粉（A对）；水丸起模常以水作为润湿剂（B对）；水丸起模有粉末直接起模、湿制颗粒起模和包衣造粒机起模等方法（C对）；水丸起模用粉量应根据药粉的性质和丸粒的规格决定（D对）。水丸注意事项：起模是泛制法制备丸剂的关键操作。因为丸模的形状直接影响成品的圆整度，其粒径和数量影响成品丸粒的规格及药物含量均匀度。起模成功的关键在于选择黏性适宜的药粉起模，如黏性过大，加水后易黏成团块；黏性过小或无黏性，药粉松散不易黏结成丸模。起模用粉量的计算生产中起模用药粉量可根据经验公式计算。水丸起模常用纯化水或冷沸水作为润湿剂。水丸起模有①粉末直接起模；②湿颗粒起模等。水丸传统采用泛制法，现代工业化生产中主要采用塑制法（又称机制法）。泛制法制丸常见问题：1.外观色泽不匀，粗糙；2.丸粒不圆整、均匀度差（E错）；3.皱缩；4.溶散超时限；5.微生物限度超标。